对水和有机溶剂均难溶的是
A. 芦荟苷
B. 番泻苷A
C. 紫草素
D. 二氢丹参醌Ⅰ
E. 丹参素

正确答案：A。芦荟苷

解析：本题考查的是碳苷的溶解度。对水和有机溶剂均难溶的是芦荟苷（A对）。碳苷（C-苷）：是一类糖基直接以C原子与苷元的C原子相连的苷类，由苷元酚基所活化的邻或对位氢与糖的端基羟基脱水缩合而成。如牡荆素、芦荟苷。碳苷类具有溶解度小，难于水解的共同特点。番泻苷A（B错）属于蒽醌苷，紫草素（C错）、二氢丹参醌Ⅰ（D错）属于游离醌类。游离醌类多溶于乙醇、乙醚、苯、三氯甲烷等有机溶剂，微溶或不溶于水。而醌类成苷后，极性增大，易溶于甲醇、乙醇、热水，几乎不溶于苯、乙醚等非极性溶剂。丹参素（E错）为酚酸类化合物，为水溶性成分。